下列因素均可引起口角炎，除外
A. 营养不良
B. 寒冷刺激
C. 细菌感染
D. 真菌感染
E. 创伤因素

正确答案：B。寒冷刺激

解析：本题考查口角炎的病因。寒冷刺激（B错，为本题的正确答案）一般不会刺激口角和口角炎无关。口角炎是发生于上下唇两侧联合处口角区的炎症总称，根据发病原因可分为感染性口角炎、创伤性口角炎（E对）、接触性口角炎和营养不良性口角炎（A对）。感染性口角炎由真菌（D对）、细菌（C对）、病毒等病原微生物引起。创伤性口角炎由口角区医源性创伤、严重的物理刺激或某些不良习惯引起。接触性口炎患者常有过敏体质，一旦接触变应原或毒性物质即可引起发病。营养不良性口角炎由营养不良、维生素缺乏引起或继发于糖尿病、贫血、免疫功能异常等全身疾病引起的营养不良。